霍乱弧菌在下述条件下不易存活，哪一项除外
A. 干燥
B. 日光
C. 酸性条件
D. 碱性条件
E. 漂白粉

正确答案：D。碱性条件